女，27岁。停经7周，阴道少量流血2天，睡前突感下腹剧痛并伴明显肛门坠胀感。诊断腹腔内出血的直接证据是
A. 宫颈举痛
B. 后穹隆饱满
C. 移动性浊音（+）
D. 腹部压痛及反跳痛
E. 后穹隆穿刺

正确答案：E。后穹隆穿刺

解析：患者，女，停经7周（异位妊娠患者多有6～8周停经史），阴道少量流血2天（60%～80%的异位妊娠患者有阴道流血，量少呈点滴状），睡前突感下腹剧痛并伴明显肛门坠胀感（当发生输卵管妊娠流产或破裂时，突感一侧下腹部撕裂样疼痛，当血液积聚于直肠子宫陷凹时，可出现肛门坠胀感）。根据本例临床表现，考虑输卵管妊娠破裂并发腹腔内出血，诊断腹腔内出血的直接证据是后穹窿穿刺（E对）。腹腔内的出血最易积聚于直肠子宫陷凹，此患者有肛门坠胀感，说明血液正积聚于直肠子宫陷凹，即使血量不多，也能经阴道后穹窿穿刺抽出血液。抽出暗红色不凝血液，说明有腹腔内出血。将宫颈轻轻上抬或向左右摆动时引起剧烈疼痛，称为宫颈举痛或摇摆痛，宫颈举痛（A错）为输卵管妊娠的主要体征之一，但并不能诊断腹腔内出血（P54）。后穹隆饱满（B错）是输卵管妊娠流产或破裂的体征，但不是诊断腹腔内出血的直接证据（P54）。移动性浊音（+）（C错）只有在出血较多时才出现（P54）。腹部压痛及反跳痛（D错）是输卵管妊娠的体征，但是对腹腔内出血的诊断特异性不大（P54）。